糖皮质激素的免疫抑制作用机制包括
A. 抑制巨噬细胞对抗原的吞噬和处理
B. 干扰淋巴细胞的识别及阻断免疫母细胞增殖
C. 抑制致敏淋巴细胞解体
D. 干扰体液免疫，使抗体生成减少
E. 消除免疫反应导致的炎症反应

正确答案：A、B、D、E。抑制巨噬细胞对抗原的吞噬和处理；干扰淋巴细胞的识别及阻断免疫母细胞增殖；干扰体液免疫，使抗体生成减少；消除免疫反应导致的炎症反应